患者，女，35岁。3周前腰腿疼痛，近5天明显，尤其遇寒冷天气则疼痛加重饮食尚可，二便正常，舌淡苔白，脉沉迟最佳选药是
A. 羌活
B. 威灵仙
C. 独活
D. 桑寄生
E. 秦艽

正确答案：C。独活

解析：独活的功效为祛风除湿，通痹止痛，解表。治疗风寒湿痹，腰膝疼痛；风寒夹湿头痛；少阴伏风头痛（C对）。羌活的功效为解表散寒，祛风除湿，止痛。治疗风寒感冒，头痛项强；风寒湿痹，肩背酸痛（A错）。威灵仙的功效为祛风湿，通经络，止痛，消骨骾。治疗风湿痹痛；骨骾咽喉（B错）。桑寄生的功效为祛风湿，补肝肾，强筋骨，安胎元。治疗治疗风湿痹痛，腰膝酸软，筋骨无力（D错）。秦艽的功效为祛风湿，清湿热，舒筋络，止痹痛，退虚热。治疗风湿痹证，筋脉拘挛，骨节酸痛；中风半身不遂；湿热黄疸；骨蒸潮热，小儿疳积发热（E错）。